7个月患儿，发热3天，体温39～40℃，流涕，轻咳。查体：一般情况好，除咽部充血外，未见其他异常，家长一直服用中药治疗。近日热退，因皮肤出现红色斑丘疹而就诊。本病的病原为
A. 麻疹病毒
B. 腺病毒
C. 人疱疹病毒6型
D. 柯萨奇病毒
E. 水痘病毒

正确答案：C。人疱疹病毒6型

解析：7个月患儿，发热3天，体温39～40℃，流涕，轻咳。查体：一般情况好，除咽部充血外，未见其他异常，近日热退而出现红色斑丘疹等符合幼儿急疹的全身症状表现，如：主要见于婴幼儿，一般情况好，耳后淋巴结可肿大等，且该患儿热退后伴皮疹出现符合幼儿急疹发热与皮疹的关系，故该患儿可能的诊断是幼儿急疹，故病原为人疱疹病毒6型柯萨奇病毒（C对）。而麻疹病毒（A错）是麻疹的病原，腺病毒（B错）对呼吸道、胃肠道、尿道和膀胱等均可感染，可引起不同的疾患，柯萨奇病毒（D错）是一种可经呼吸道和消化道感染的肠病毒，感染后可出现发热、打喷嚏、咳嗽等感冒症状，水痘病毒（E错）是水痘的病原。